将已经明确的事物之间的联系一一排除，再研究剩余的因素与疾病之间的关系
A. 求同法
B. 求异法
C. 共变法
D. 排除法
E. 类比法

正确答案：D。排除法